治疗巨幼红细胞性贫血的药物是
A. 硫酸亚铁
B. 叶酸
C. 重组人促红素
D. 重组人粒细胞刺激因子
E. 维生素 K

正确答案：B。叶酸

解析：本题考查叶酸。叶酸（B对）缺乏会引起巨幼红细胞性贫血。服用叶酸后可迅速纠正巨幼红细胞性贫血的异常现象，改善贫血。硫酸亚铁（A错）用于缺铁性贫血。重组人促红素（C错）临床上用于肾功能不全所致的肾性贫血、恶性肿瘤化疗所致贫血，外科围手术期的红细胞动员、早产儿贫血。重组人粒细胞刺激因子（D错）主要用于肿瘤化疗所致的中性粒细胞减少症及再生障碍性贫血。维生素K（E错）为促凝血药。